病毒性心肌炎病变过程中的病理产物是
A. 痰瘀湿阻
B. 痰湿内热
C. 风热邪毒
D. 瘀血痰浊
E. 湿热邪毒

正确答案：D。瘀血痰浊

解析：本病以外感风热、湿热邪毒为发病主因，瘀血、痰浊为主要病理产物。气阴耗伤，血脉受阻为主要病理变化。病变部位主要在心，常涉及肺、脾、肾。病程中或邪实正虚，或以虚为主，或虚中夹实，病机演变多端，特别要警惕心阳暴脱变证的发生（D对）。